治疗支气管哮喘应选用
A. 新斯的明
B. 阿托品
C. 多巴胺
D. 异丙肾上腺素
E. 酚妥拉明

正确答案：D。异丙肾上腺素

解析：本题考查异丙肾上腺素。治疗支气管哮喘应选用异丙肾上腺素（D对）。异丙肾上腺素为β受体激动剂，通过激动β受体而激活支气管平滑肌的腺苷酸环化酶，催化cAMP的合成，激活cAMP依赖蛋白激酶而松弛支气管平滑肌。新斯的明（A错）为易逆性抗胆碱酯酶药，临床用于重症肌无力、腹气胀和尿潴留以及肌松药过量中毒的解救。阿托品（B错）是M受体阻断剂，可用于各种内脏绞痛、抗心律失常及解救有机磷酸酯类中毒。多巴胺（C错）主要激动α、β受体和外周的多巴胺受体，并促进神经末梢释放NA，临床上用于各种休克、急性肾衰竭。酚妥拉明（E错）是α₁、α₂受体，临床用于治疗外周血管痉挛性疾病、抗休克及心力衰竭等。